下列关于阻塞性肺气肿的说法正确的是
A. 各种因素刺激引起终末细支气管远端的气道弹性减退
B. 肺泡过度膨大
C. 肺通气和肺容量增大
D. 伴有气道壁的破坏
E. 以上均正确

正确答案：E。以上均正确

解析：阻塞性肺气肿是指因各种有害因素的刺激引起终末细支气管远端的气道弹性减退，过度膨胀、充气和肺容量增大，并伴有气道壁的破坏。掌握“慢性阻塞性肺疾病”知识点。